女，35岁，半年前母突然病故，此后失眠情绪低沉，不愿与人交往。近三个月来独处时常听见有声音对她讲话，说母亲病故与某人有关，故多次给公安机关写信反映母亲被害之事，后来又感到自己的思维情感不由自己支配，自己的想法还未说出已人人皆知，常独自哭泣。神经系统检查未见异常，有慢性肝炎病史3年，目前肝功ALT80U/L。该患者治疗首选的药物是
A. 氯硝安定
B. 氟西汀
C. 氯丙嗪
D. 丙咪嗪
E. 利培酮

正确答案：E。利培酮

解析：该病例为青年女性，时常听到有声音对她讲话（言语性幻听）、自己的想法还未说出已人人皆知（思维被洞悉妄想）为主要表现，且近三个月来独处（在妄想、幻觉的支配下的表现行为），诊断精神分裂症，伴有失眠情绪低沉，常独处暗自哭泣（伴抑郁症状），首选治疗措施为抗精神病药物治疗，氯丙嗪和利培酮均为抗精神病药物，因患者有3年慢性肝炎病史，肝功能ALT（谷丙转氨酶） 升高（正常值0-40U/L），提示肝功能损伤，故慎用氯丙嗪（C错），故首选利培酮（E对）。氯硝安定（氯硝西泮）为广谱抗癫痫药物，可治疗各型癫痫（A错）。精神分裂症伴抑郁症状应辅助药物（如抗抑郁药）或电抽搐治疗。氟西汀和丙咪嗪均为抗抑郁药，为辅助药物，不作首选（BD错）。